某女，45岁。因月经不调就诊，症见月经提前，经期延长，经血暗红，量少，咽干颧红，心烦潮热，腰膝酸软；舌红苔少，脉沉细无力。治以滋补肝肾、止血调经，处方如下：熟地黄12g，生山药9g，山萸肉9g，枸杞子9g，菟丝子12g，川牛膝9g，制何首乌12g，黄芩6g，女贞子12g，墨旱莲9g，仙鹤草12g，夏枯草9g，西洋参（另煎）6g，鹿角胶（烊化）6g，龟甲胶（烊化）9g；14剂，水煎服，每日1剂，早晚分服。该患者服用汤剂2周后，出现食欲不振、厌油腻、巩膜黄染等症状，检验指标显示血清丙氨酸氨基转移酶、天门冬氨酸氨基转移酶、总胆红素、结合胆红素、非结合胆红素均升高，其临床意义是
A. 肾功能损伤
B. 肝细胞性黄疸
C. 急性胃肠炎
D. 溶血性黄疸
E. 急性胰腺炎

正确答案：B。肝细胞性黄疸

解析：本题考查尿胆红素（BIL）阳性临床意义。患者患有肝细胞黄疸（B对）。尿胆红素（BIL）胆红素是血红蛋白的降解产物，正常尿液中不会含有胆红素，尿胆红素的检出是提示肝细胞损伤和鉴别黄疸的重要指标。在临床诊断和判断预后上有重要意义。【参考值】定性：阴性。定量：≤2mg/L【临床意义】尿胆红素阳性多见于如下情况。1.肝细胞性黄疸病毒性肝炎、肝硬化、酒精性肝炎、药物性肝损伤。2.阻塞性黄疸如化脓性胆管炎、胆囊结石、胆道肿瘤、胰腺肿瘤、原发性肝癌、手术创伤所致的胆管狭窄等。川楝子有小毒，长期大量使用可能导致肝功能损伤（A错），《药典》规定内服剂量为5～10g。【粪常规检查】粪外观：稀糊状或水样粪便常由肠蠕动亢进、水分吸收不充分所致，见于各种肠道感染性或非感染性腹泻，或急性胃肠炎（C错）；若出现大量的黄绿色稀便并含有膜状物则应考虑伪膜性肠炎症；大量水样便也可见于艾滋病患者的肠道孢子虫感染。血清总胆红素（STB）由非结合胆红素（UCB）和结合胆红素（CB）组成。UCB在水中的溶解度低，不能通过肾小管由尿液排出；而CB在水中溶解度高，能通过肾小管由尿液排出，故尿中的胆红素是CB。溶血性黄疸时，红细胞破坏过多，血中UCB增加；阻塞性黄疸时，肝脏中CB反流进血中，血中CB增加；肝细胞黄疸时，肝脏代谢UCB能力下降及肝细胞损害，肝脏血循环异常，CB反流入血，使血中CB和UCB均增加。【参考值】STB：成人 3.4～17.lμmol/L；新生儿0～1天 34～103μmol/L；1～2天 103～171μmol/L；3～5天 68～137μmol/L；CB:0～6.8μmol/L；UCB: 1.7～10.2μmol/L；CB/UCB: 0.2～0.4；【临床意义】1.反映黄疽程度 STB 17.1～34.2μmol/L为隐性黄疸；34.2～171μmol/L为轻度黄疸；171～342μmol/L为中度黄疸；>342μmol/L为重度黄疸。2.推断黄疽病因：STB<85.5μmol/L考虑溶血性黄疸（D错）；17.1～171μmol/L考虑肝细胞性黄疸；171～342μmol/L考虑不完全梗阻性黄疸；>342μmol/L考虑完全性梗阻性黄疸。3.鉴别黄疽类型STB与UCB增高，为溶血性黄疸。STB与CB增高，为阻塞性黄疸。STB、UCB和CB均增高，为肝细胞性黄疸。4.CB/STB比值变化CB/STB<0.2，为溶血性黄疸。CB/STB0.2～0.5，为肝细胞性黄疸。CB/STB>0.5，为阻塞性黄疸。尿淀粉酶（UAMY）：淀粉酶可催化淀粉分子中葡萄糖苷水解，产生糊精、麦芽糖或葡萄糖。它是一种需钙的金属酶，易由肾脏排出，半衰期很短。参考值：100～1200U/L【临床意义】1.尿淀粉酶增高（1）急性胰腺炎（E错）发作期尿淀粉酶活性上升稍晚于血清淀粉酶（发病后12～24小时开始升高），且维持时间稍长。（2）其他疾病：如胰头癌、流行性腮腺炎、胃溃疡穿孔也可见尿淀粉酶增高。2.尿淀粉酶减少主要见于重症肝炎、肝硬化、糖尿病等。